小儿肺炎喘嗽心阳虚衰证的主要病理机制是
A. 肾阳虚损，心阳不振
B. 脾阳虚损，心阳失养
C. 肺气虚衰，心阳不振
D. 气滞血瘀，心阳不振
E. 肺气郁闭，百脉失养

正确答案：D。气滞血瘀，心阳不振

解析：由于邪毒炽盛，损伤原本不足之心阳，肺闭气郁导致血滞而络脉瘀阻，而使气滞血瘀，心阳不振（D对）。肺炎喘嗽的心阳虚衰多由于肺气闭塞,气机不利致气滞血瘀，而使心阳虚衰，非由于肾阳虚损所致（A错）。脾阳虚损与心阳虚衰无直接联系（B错）。肺气闭郁所致气滞血瘀非肺气虚衰（C错）。肺气闭郁致气滞血瘀，而后至心阳虚衰，百脉失养非其病理机制（E错）。